决定急性肠梗阻手术探查的最主要依据是
A. 是否为绞窄性肠梗阻
B. 近端肠管扩张程度
C. 梗阻部位
D. 是否为完全性梗阻
E. 梗阻持续时间

正确答案：A。是否为绞窄性肠梗阻

解析：绞窄性肠梗阻易使相应的肠段急性缺血，所以为了避免肠坏死、穿孔，应尽早剖腹探查（A对）解除梗阻，恢复血液循环。